择期手术患者，手术前需要进行特殊准备的是
A. 血红蛋白120g/L
B. 空腹血糖5.6mmol/L
C. 血压160/100mmHg
D. 血小板100×10⁹/L
E. 白细胞7.0×10⁹/L

正确答案：C。血压160/100mmHg

解析：血压过高者，麻醉诱导和手术应激可使脑血管意外和充血性心力衰竭等危险增加，术前应选用合适的降压药物，使血压平稳在一定水平，但不要求降至正常后才做手术。病人血压在160/100mmHg以下，可不必作特殊准备，若血压为160/100mmHg，可适当降压（C对）。糖尿病病人的手术耐受力差，术前需维持血糖轻度升高状态（5.6-11.2mmol/L）（B错）。如果临床确定有凝血障碍，择期手术前应作相应的治疗，当血小板<50xl0⁹/L，建议输血小板；大手术或涉及血管部位的手术，应保持血小板达75xl0⁹/L；神经系统手术，血小板临界点不小于100xl0⁹/L（D错）。术前一般要求血红蛋白≥80g/L，血浆白蛋白≥30g/L（A错）。术前对白细胞数量无特别要求（E错）。